SO₂和下列哪种污染物共同作用后可大大增加SO₂的毒性
A. CO
B. CO₂
C. PAH
D. 可吸入颗粒物
E. NOₓ

正确答案：D。可吸入颗粒物

解析：本题考查可使SO₂毒性增加的污染物。SO₂和可吸入颗粒物（D对ABCE错）共同作用后可大大增加SO₂的毒性。吸附在可吸入颗粒物上的SO₂，进入肺深部，其毒性增加3～4倍。可吸入颗粒物中的三氧化铁等金属氧化物，可催化SO₂氧化成硫酸雾，它的刺激作用比SO₂大10倍。